体内肌肉能量的储存形式是
A. CTP
B. ATP
C. 磷酸肌酸
D. 磷酸烯醇式丙酮酸
E. 所有的三磷酸核苷酸

正确答案：C。磷酸肌酸